通过拮抗M胆碱受体，产生抗胆碱活性的药物是
A. 硝酸毛果芸香碱
B. 溴新斯的明
C. 溴丙胺太林
D. 氯化琥珀胆碱
E. 泮库溴铵

正确答案：C。溴丙胺太林